新型隐球菌荚膜用什么染色
A. 瑞氏染色
B. 抗酸染色
C. 墨汁负染色
D. 棉兰染色
E. 革兰染色

正确答案：C。墨汁负染色

解析：本题考查隐形菌。新型隐球菌荚膜用墨汁负染色（C对）。瑞氏染色（A错）适用于组织胞浆菌。抗酸染色（B错）用于结核分枝杆菌。棉兰染色（D错）主要用于真菌。革兰染色（E错）用于链球菌属。